固冲汤和归脾汤均具有的治疗作用是
A. 补气摄血
B. 养血安神
C. 养血调经
D. 滋阴清热
E. 益气升阳

正确答案：A。补气摄血

解析：固冲汤方中重用白术、黄芪补气健脾，以摄血、固冲，为君药；山茱萸、白芍补益肝肾，以调固冲任，共为臣药；佐以煅龙骨、煅牡蛎、棕榈炭、五倍子，功专收敛固涩，以止血，同时配以海螵蛸、茜草化瘀止血，使血止而不留瘀。全方共奏益气健脾、固冲止血之功。归脾汤方中黄芪甘温，益气补脾，龙眼肉甘平，既补脾气，又养心血以安神，为君药。人参、白术补脾益气，助黄芪益气生血；当归补血养心，助龙眼肉养血安神，为臣药；茯神、酸枣仁、远志宁心安神；木香辛香而散，理气醒脾，为佐药。炙甘草补气调中，为佐使药。用法中姜、枣调和脾胃，以资化源。全方共奏益气补血（摄血），健脾养心之功（A对）。